目前胰腺癌患者预后较差的最主要原因是
A. 患者消化不良，营养状况差
B. 胰、十二指肠切除术，对患者创伤大
C. 黄疸对肝功能影响较大
D. 肿瘤细胞胰管浸润
E. 早期症状不明显，发现和确诊晚

正确答案：E。早期症状不明显，发现和确诊晚

解析：胰腺癌早期缺乏特异的临床表现。胰腺癌常见的首发症状为上腹部疼痛及不适，容易忽略，就诊率低。黄疸是胰头癌的最主要临床表现，但黄疸出现时间与癌块位置有关。癌块距离胆总管越近，黄疸出现越早。病人因出现黄疸而就医时，多数已属于中晚期，此时癌多发生转移，手术切除率低，预后较差。综上，目前胰腺癌患者预后较差的最主要原因是早期症状不明显，发现和确诊晚（E对）。